机体排出水分的途径有
A. 消化道
B. 皮肤
C. 肺
D. 肾
E. 以上都是

正确答案：E。以上都是

解析：水的来源有饮水、食物水、代谢水，排出水分的途径有消化道（A对）、皮肤（B对）、肺（C对）和肾（D对，故E为本题正确答案）。